初孕妇，26岁。妊娠33周，用胰岛素治疗糖尿病，今晨5时惊醒，心悸、出汗。此时最有效的处理措施是
A. 检测血糖
B. 检测尿糖及酮体
C. 进食
D. 静脉注射胰岛素
E. 测量体温

正确答案：C。进食

解析：患者使用胰岛素治疗糖尿病后，清晨出现心慌出汗，考虑出现低血糖症，最有效的处理措施是进食糖类食物（C对）。检测血糖（A错）、检测尿糖及酮体（B错）仅作为糖尿病的一般监测方法，不能及时改善该孕妇的症状。本例患者出现了低血糖的症状，静脉注射胰岛素（D错）会加重低血糖。测量体温（E错）对于本例意义不大。